下列关于内陷的含义说法最准确的是
A. 凡生痈疡，毒不外泄，反陷入里
B. 有头疽，毒不外泄，反陷入里
C. 脑疽，毒不外泄，反陷入里
D. 正虚或消渴病病人，毒不外泄，反陷入里
E. 疔疮以外的疮疡，毒不外泄，反陷入里

正确答案：E。疔疮以外的疮疡，毒不外泄，反陷入里

解析：内陷是除疔疮以外的其他阳证疮疡疾患过程中，因正气不足，火毒炽盛，正不胜邪，毒不外泄，反陷入里（E对），客于营血，内传脏腑的一种危急病证。多由疽患者并发，故名疽毒内陷。其临床特点是肿势隆起的疮顶忽然内陷，或溃疡脓腐未净而忽然干枯无脓，或脓净创面红活而忽变光白板亮，伴邪盛热极或正虚邪盛或阴阳两竭的全身证候。